某地相继发生多例以急性发病、高热、头痛等症状为主要临床表现的病因不明的疾病，被确定为突发公共卫生事件。当地乡卫生院以床位紧张为由，拒绝收治此类患者。县卫生局经调查核实后，决定给予乡卫生院行政处罚。应予什么处罚
A. 限期整改
B. 责令改正
C. 责令检测
D. 警告
E. 通报批评

正确答案：B。责令改正

解析：某地相继发生多例以急性发病高热头痛等症状为主要临床表现的病症，属于群体性不明原因疾病。根据《突发公共卫生事件应急条例》规定，医疗机构未依照规定及时采取控制措施的、未履行突发事件监测职责的、拒绝接诊病人的、拒不服从突发事件应急处理指挥部调度的，由卫生行政部门责令整改、通报批评、给予警告。某诊所拒绝接受患者，未明说造成严重后果的，应由卫生行政部门责令改正（B对）。